中医学认为原发性高血压病的病机性质是
A. 本虚标实
B. 肝脾疏运失调
C. 肺肾吐纳失调
D. 心肾交济失调
E. 心肺相辅失调

正确答案：A。本虚标实

解析：中医学认为原发性高血压的主要病因为情志失调、饮食不节、久病劳伤、先天禀赋不足等，主要病理环节为风、火、痰、瘀、虚，与肝、脾、肾等脏腑关系密切，病机性质是本虚标实（A对），即以肝肾阴虚为本，肝阳上亢、痰浊内蕴为标。肝脾疏运失调（B错）、肺肾吐纳失调（C错）、心肾交济失调（D错）、心肺相辅失调（E错）等均不是原发性高血压病的病机性质。